氟脲嘧啶的主要不良反应是
A. 骨髓抑制
B. 神经毒性
C. 恶心呕吐
D. 神经性皮炎
E. 肝功能损害

正确答案：A。骨髓抑制

解析：本题考查氟脲嘧啶的不良反应。氟脲嘧啶是抗代谢类化疗药物。不良反应有：①骨髓抑制（A对），为氟脲嘧啶主要的不良反应，表现为白细胞减少、血小板下降；②胃肠道反应，表现为食欲不振、恶心呕吐（C错）、胃炎腹痛、肝功能损害（E错）等；③注射局部有疼痛、静脉炎或动脉内膜炎；④其他，常有脱发、神经性皮炎（D错）、皮肤色素沉着、暂时性小脑运动失调，神经毒性（B错）,偶有影响心脏功能。